女，65岁。多关节肿痛2年，晨僵约1小时，查体：双手掌指关节对称性肿胀，压痛，双手X线，双侧低2、3掌指关节骨破坏，该疾病主要治疗药物不包括
A. 羟氯喹
B. 来氟米特
C. 柳氮磺吡啶
D. 甲氨蝶呤
E. 别嘌醇

正确答案：E。别嘌醇

解析：患者老年女性（类风湿关节炎＞40岁女性易患），多关节肿痛2年，查体：双手掌指关节对称性肿胀，压痛。双手X线：双侧第2、3掌指关节骨破坏（提示多关节、小关节肿痛）。晨僵约1小时（类风湿关节炎活动指标之一）。据患者的临床表现、体格检查及影像学检查提示，患者患有典型的类风湿关节炎（RA）。临床针对类风湿关节炎的药物治疗包括非甾体类抗炎药（NSAIDs）、传统DMARDs、生物DMARDs、糖皮质激素（GC）及植物药。其中传统DMARDs可延缓和控制病情，RA一经确诊，应早期使用传统DMARDs药物，它包括抗疟药羟氯喹（A对）和氯喹、来氟米特（B对）、柳氮磺吡啶（C对）、甲氨蝶呤（D对）。别嘌醇（E错，为本题正确答案）具有抑制尿酸合成的作用，一般用于痛风患者的降尿酸治疗。